某筛选试验用被病例诊断为乳癌患者和非乳癌患者各400名妇女，试验结果乳癌组阳性者100人，非乳癌组阳性者50人，问该试验的特异度为
A. 0.875
B. 0.67
C. 0.25
D. 0.33
E. 0.12

正确答案：A。0.875

解析：本题考查特异度的计算。根据题中数据代入公式得出特异度＝TN/（FP＋TN）＝350/400×100%＝87.50%（A对BCDE错）。